肾病综合征最基本的表现是
A. 尿蛋白定量＞3.5g/24h
B. 尿颗粒管型
C. 血浆白蛋白＜35g/L
D. 高度浮肿
E. 高脂血症

正确答案：A。尿蛋白定量＞3.5g/24h

解析：肾病综合征诊断标准是：①尿蛋白大于3.5g/d；②血浆白蛋白低于30g/L；③水肿；④血脂升高，其中最基本的表现是尿蛋白定量＞3.5g/24h（A对）及低白蛋白血症（血浆白蛋白低于30g/L）（C错）。肾病综合征可有水肿，但不一定是高度浮肿（D错）。高脂血症（E错）是肾病综合征的诊断标准之一，但不是必备条件，故其不是肾病综合征最基本的表现。尿颗粒管型（B错）多见于各种肾小球疾病及肾小管的毒性损伤，肾病综合征患者可见，但不是其最基本的表现。